进入机体化学物的剂量与某个机体所呈现出的生物效应强度间的关系被称为
A. 有效剂量
B. 作用强度
C. 剂量-反应关系
D. 剂量-效应关系
E. 相关关系

正确答案：D。剂量-效应关系

解析：本题考查剂量-效应关系。剂量-效应关系（D对ABCE错）是指进入机体的化学物质的剂量与机体所呈现出的生物效应强度之间的关系。它是一种定量的关系，即机体接受的剂量越大，机体所呈现出的生物效应强度也越大。